反映药物最大效应的指标是
A. 效价
B. 治疗量
C. 治疗指数
D. 阈剂量
E. 效能

正确答案：E。效能

解析：本题考查效能。反映药物最大效应的指标是效能（E对）。在一定范围内，增加药物剂量或浓度，其效应随之增加，但效应增至一定程度时，若继续增加剂量或浓度而效应不再继续增强，此药理效应的极限称为最大效应，也称效能。效能反映了药物的内在活性。效价（A错）用于作用性质相同的药物之间的等效剂量或浓度的比较，指能引起等效反应(一般采用50%效应量）的相对剂量或浓度，值越小则强度越大。药物LD₅₀与ED₅₀的比值表示药物的安全性，称为治疗指数（TI）。治疗指数（C错）反映药物安全性。药物发挥药理作用要达到最小有效剂量，也称阈剂量（D错）。当药物剂量高于阈剂量时，药效随剂量的增加而加大，增大到一定浓度后效应便不再增加。